慢性痛风和痛风性肾病，为抑制尿酸生成，可选用
A. 别嘌醇
B. 秋水仙碱
C. 泼尼松龙
D. 苯溴马隆
E. 双氯芬酸

正确答案：A。别嘌醇

解析：本题考查痛风治疗药。慢性痛风和痛风性肾病，为抑制尿酸生成，可选用别嘌醇（A对）。秋水仙碱（B错）为痛风急性发作期首选药。波尼松龙（C错）用于痛风急性期发作的治疗，但停药后易复发。当其它抗痛风药物治疗无效或不能使用时，可短程使用。苯溴马隆（D错）为促尿酸排泄药。双氯芬酸（E错）能抑制前列腺素的合成，镇痛和抗炎，且能抑制尿酸盐结晶的吞噬，可作为急性期的基本用药，或在秋水仙碱疗效不好时作为替代药。